以下关于脑发育说法错误的是
A. 小儿进行早期教养的关键年龄在3岁以前
B. 外界刺激越频繁，脑细胞发育速度越快
C. 大脑发育需要新陈代谢所需的营养物质
D. 大脑发育随婴儿年龄增长而自然成熟
E. 大脑需要外界环境的刺激和影响

正确答案：D。大脑发育随婴儿年龄增长而自然成熟

解析：本题考查神经心理发育的相关内容。大脑发育并非随婴儿年龄增长而自然成熟（D错，为本题正确答案），只有在外界环境对神经系统的刺激过程中，大脑才能得到充分的发展和完善。在3岁以前对幼儿进行早期教养是关键年龄（A对）；大脑的发育需要新陈代谢所需的营养物质（C对）及外界环境的刺激和影响（E对），外界刺激越频繁，脑细胞发育速度越快（B对）。